利用扩散原理达到缓（控）释作用的方法不包括
A. 制成包衣小丸
B. 制成微囊
C. 制成植入剂
D. 制成不溶性骨架片
E. 制成渗透泵片

正确答案：E。制成渗透泵片